评价一个致病因子的公共卫生学意义，宜选用
A. 绝对危险度
B. 相对危险度
C. 特异度
D. 归因危险度百分比
E. 人群归因危险度

正确答案：E。人群归因危险度